发生霍乱时，对疫区接触者的检疫期是
A. 3天
B. 5天
C. 7天
D. 9天
E. 12天

正确答案：B。5天

解析：发生霍乱时，对疫区接触者的检疫期是5天（B对），患者及带菌者是霍乱的主要传染源，患者在发病期间，可连续排菌，时间一般为5日。